复发性疱疹性口炎一般好发部位
A. 口唇
B. 颊黏膜
C. 舌背
D. 牙龈
E. 腭黏膜

正确答案：A。口唇

解析：本题考查复发性疱疹性口炎的好发部位。复发性疱疹性口炎一般好发部位是口唇（A对）或接近口唇处，故又称复发性唇疱疹，少数复发损害可影响到牙龈（D错）和腭黏膜（E错），颊黏膜（B错）和舌背（C错）罕见。